以下关于舌神经阻滞麻醉错误的是
A. 麻醉同侧下颌舌侧牙龈
B. 同侧舌有烧灼、肿胀、麻木感
C. 一般舌神经出现麻醉征象较下牙槽神经为早
D. 下牙槽神经麻醉口内注射后，将注射针退出0.5cm此时注射麻醉舌神经
E. 边退边注射麻醉药

正确答案：D。下牙槽神经麻醉口内注射后，将注射针退出0.5cm此时注射麻醉舌神经

解析：本题考查颌面部常用局麻法及牙拔除的麻醉选择。舌神经阻滞麻醉：注射方法：在行下牙槽神经麻醉口内注射后，将注射针退出1cm（D错，为本题正确答案），此时注射麻药0.5～1ml，即可麻醉舌神经，或在退针时，边退边注射麻醉药（E对），直到针尖退至黏膜下为止。麻醉区域：同侧下颌舌侧牙龈（A对）、黏骨膜、口底黏膜及舌前2/3部分。麻醉效果：同侧舌有烧灼、肿胀、麻木感（B对），尤以舌尖部更为明显，同时行下牙槽神经麻醉者，一般舌神经出现麻醉征象较下牙槽神经为早（C对）。